正确处理医务人员之间关系的意义应除外
A. 有利于医学事业发展
B. 有利于医院集体力量发挥
C. 有利于医务人员成才
D. 有利于建立和谐医患关系
E. 有利于内部共同创收

正确答案：E。有利于内部共同创收

解析：处理好医务人员之间关系的意义：①它是当代医学发展的客观需要；②它有利于发挥医疗卫生保健机构的整体效应；③它有利于医务人员的成才；④它有利于建立和谐的医患关系。掌握“医务人员之间关系伦理”知识点。